8位氟原子存在可产生较强光毒性的喹诺酮类抗生素是
A. 盐酸环丙沙星
B. 盐酸诺氟沙星
C. 司帕沙星
D. 加替沙星
E. 盐酸左氧氟沙星

正确答案：C。司帕沙星

解析：本题考查喹诺酮类抗菌药。司帕沙星（C对）8位有氟原子取代，具有较强的光毒性。诺氟沙星（B错）、环丙沙星（A错）均是在6位引入的氟原子。加替沙星（D错）8位取代基为8-甲氧基。左氧氟沙星（E错）1位和8位成环。